根据作用机制分析，奥美拉唑是
A. 粘膜保护药
B. 胃壁细胞H⁺泵抑制药
C. 胃泌素受体阻断药
D. H₂受体阻断药
E. M胆碱受体阻断药

正确答案：B。胃壁细胞H⁺泵抑制药

解析：治疗消化性溃疡的药物包括抗酸药、抑制胃酸分泌药（H受体阻断药、质子泵抑制药、M胆碱受体阻断药和胃泌素受体阻断药）、增强胃粘膜屏障功能的药物、抗幽门螺杆菌药。根据作用机制分析，奥美拉唑是质子泵抑制药（B对），与H⁺-K⁺-ATP酶的α亚单位的巯基共价结合使酶失活，减少胃酸分泌。胃粘膜保护药（A错）（P306）增强胃粘膜屏障功能的药物，常用的有米索前列醇、恩前列素、硫糖铝等。胃泌素受体阻断药（C错）（P306）胃泌素竞争胃泌素受体，有抑制胃酸分泌的作用，主要是丙谷胺。H₂受体阻断药（D错）（P304）竞争性的阻断壁细胞基底膜的H₂受体，导致胃酸分泌减少，主要由雷尼替丁、西咪替丁等。M胆碱受体阻断药（E错）（P306）阻断胃壁细胞上的M受体，抑制胃酸分泌，主要有阿托品、哌仑西平等。